属于神经氨酸酶抑制剂的抗流感病毒药是
A. 拉米夫定
B. 更昔洛韦
C. 利巴韦林
D. 阿德福韦酯
E. 奥司他韦

正确答案：E。奥司他韦

解析：本题考查抗流感病毒药。属于神经氨酸酶抑制剂的抗流感病毒药是奥司他韦（E对）。奥司他韦是其活性代谢产物的药物前体，其活性代谢产物（奥司他韦狻酸盐）是选择性的流感病毒神经氨酸酶抑制剂。拉米夫定（A错）和阿德福韦酯（D错）为核苷类逆转录酶抑制剂。更昔洛韦（B错）为DNA多聚酶抑制剂。利巴韦林（C错）是广谱抗病毒药。